不影响药物溶出速度的有
A. 粒子大小
B. 颜色
C. 晶型
D. 旋光度
E. 溶剂化物

正确答案：B、D。颜色；旋光度

解析：本题考查影响药物溶出速度的因素。颜色（B对）和旋光度（D对）不是影响药物溶出速度的因素。粒子大小、晶型、溶剂化物均能影响溶出速度，颗粒越大，溶出速率减慢；晶型不同，溶出速率也不同；溶剂化物溶出速度：水合物<无水物<有机溶剂化物。